T细胞分化成熟的场所是
A. 骨髓
B. 淋巴结
C. 胸腺
D. 外周免疫器官
E. 脾

正确答案：C。胸腺